某医院口腔颌面外科医师在进行病房换药时，该医师在以下操作方法中，不正确的做法是
A. 棉球清洁暴露创面时是“蘸”的动作
B. 持镊应在上1/3处
C. 应用刺激性的药物消毒更彻底
D. 使用过的棉球不可再置入消毒的换药碗内
E. 保持一“脏”一“净”，即一镊接触创面，一镊接触药碗和消毒敷料

正确答案：C。应用刺激性的药物消毒更彻底

解析：换药的动作要准确、轻巧、细致，切忌粗暴。应用棉球清洁暴露创面时是“蘸”而不是“揩”、“擦”的动作。对暴露创面不可应用带刺激性的药物，动作要迅速，尽量缩短时间，勿使创面暴露时间过长。掌握“口外创口处理”知识点。